肝性脑病时使用甲硝唑的原因为
A. 抑制细菌减少氨形成
B. 维持氨基酸平衡
C. 减少氨的吸收
D. 促进氨代谢
E. 减少假性神经递质产生

正确答案：A。抑制细菌减少氨形成

解析：口服甲硝唑可抑制细菌减少氨气形成（A对）。服用乳果糖可降低肠道PH，减少氨的吸收（C错）。使用L-鸟氨酸-L-天冬氨酸可促进氨代谢（D错）。补充支链氨基酸有助于减少假性神经递质的形成（E错）。